婴幼儿支气管哮喘的表现是
A. 阵发性咳嗽
B. 喘息反复发作
C. 犬声样咳嗽
D. 喘憋明显
E. 清晨发作性咳嗽，痰少

正确答案：B。喘息反复发作

解析：支气管哮喘的临床表现主要为反复发作的喘息，夜间和（或）清晨发作或加剧（B对）。麻疹并发的喉炎临床会出现声音嘶哑、犬样咳嗽、吸气性呼吸困难及三凹征（C错）。喘憋明显多见于毛细支气管炎（D错）。婴幼儿咳嗽变异性哮喘，常在清晨和（或）夜间发作以干咳少痰为主（E错）。“咳嗽和喘息呈阵发性发作，以夜间和清晨为重”，可知A选项也正确，本题不严谨。